估计流感流行所导致的疾病负担所选用的指标是
A. 发病率
B. 罹患率
C. 超额死亡率
D. 病死率
E. 死亡率

正确答案：C。超额死亡率

解析：本题考查超额死亡率的相关内容。流感的超额死亡率即流感流行高峰期的观察死亡率与非流行期死亡率基线之差。研究中多采用数学模型的方法建立死亡率基线，比较流行期死亡率与非流行期死亡率基线之差，以流感的超额死亡率（C对ABDE错）来估计其流行所导致的疾病负担。